影响血管内外液体交换的因素中下列哪一因素不存在
A. 毛细血管流体静压
B. 血浆晶体渗透压
C. 血浆胶体渗透压
D. 微血管壁通透性
E. 淋巴回流

正确答案：B。血浆晶体渗透压

解析：血管内外的液体交换维持着组织液的生成与回流的平衡。影响血管内外液体交换的因素主要有：①毛细血管流体静压（A错）和组织间液胶体渗透压，促使液体滤出毛细血管；②血浆胶体渗透压（C错）和组织间液流体静压，促使液体回流至毛细血管；③淋巴回流（E错）的作用：正常情况下，淋巴回流不仅能把组织液及其所含蛋白回收到血液循环，而且在组织液生成增多时还能代偿回流；④正常时，毛细血管只允许微量蛋白质滤出，当微血管壁通透性（D错）增高时血浆蛋白从毛细血管和微静脉壁滤出。血浆晶体渗透压（B对）主要影响细胞内外液体交换，而不是血管内外液体交换。